下列哪项说明了四缝穴的位置
A. 手2～5指掌侧，掌指关节横纹中点处
B. 手1～4指掌侧，指骨关节横纹中点处
C. 手l～4指掌侧，近端指关节横纹中央
D. 手1～5指间，指蹼缘后方赤白肉际处
E. 手2～5指掌侧，近端指关节的中央

正确答案：E。手2～5指掌侧，近端指关节的中央

解析：在手指，第2-5指掌面的近侧指间关节横纹的中央（E对），一手4穴。